药物信息的内涵是
A. 临床药学的一项重要工作
B. 药疗保健的一项重要工作
C. 直接关系到合理用药的信息
D. 为社区居民更好服务的信息
E. 研究和开发新药的一项重要工作

正确答案：A、B、C、D。临床药学的一项重要工作；药疗保健的一项重要工作；直接关系到合理用药的信息；为社区居民更好服务的信息

解析：本题考查的是药物信息的内涵。药物信息的内涵是临床药学的一项重要工作（A对）、药疗保健的一项重要工作（B对）、直接关系到合理用药的信息（C对）、为社区居民更好服务的信息（D对）。药物信息是临床药学和药疗保健的一项重要工作和活动，由于药物信息直接关系到合理用药，所以执业药师必须掌握收集、整理、加工和利用药物信息的本领，以便为杜区居民更好地服务。